在我国，属于合法用药的是
A. 注射剧毒药物使心跳停止，实行安乐死
B. 口服避孕药物，实行计划生育
C. 口服合成雄激素，以夺取百米冠军
D. 口服利尿剂，减轻体重以参加举重比赛
E. 注射安钠咖，减少睡眠以保证加班工作

正确答案：B。口服避孕药物，实行计划生育

解析：本题考查合法用药。在我国，属于合法用药的是口服避孕药物，实行计划生育（B对）。避孕的方式有很多种，除了药物避孕外还有工具避孕，宫内节育器，自然避孕等，这都是国家允许的，合法的，为控制人口数量和提高人口质量而实行的，故口服避孕药物，实行计划生育是合法的。注射剧毒药物使心跳停止，实行安乐死（A错）、口服合成雄激素，以夺取百米冠军（C错）、口服利尿剂，减轻体重以参加举重比赛（D错）、注射安钠咖，减少睡眠以保证加班工作（E错）均属于违法行为。